下列为参与体内肝生物转化的反应类型，例外的是
A. 氧化反应
B. 还原反应
C. 水解反应
D. 结合反应
E. 裂解反应

正确答案：E。裂解反应